喹诺酮类药物的作用机制是
A. 抑制细菌蛋白质合成
B. 抑制细菌代谢
C. 干扰细菌核酸代谢
D. 抑制细菌细胞壁合成
E. 干扰真菌细胞膜功能

正确答案：C。干扰细菌核酸代谢

解析：本题考查喹诺酮类的作用机制。干扰细菌核酸代谢（C对）的为喹诺酮类。抑制细菌蛋白质合成（A错）的有氨基糖苷类、林可霉素类等。抑制细菌代谢（B错）的是磺胺类抗菌药物。抑制细菌细胞壁合成（D错）的有头孢菌素类和青霉素类等。干扰真菌细胞膜功能（E错）的为两性霉素B。